某电焊辅助工，工作4小时后，突然感到眼发干、异物感，并肿胀而被送医院就诊。此工人可能患哪种疾病
A. 眼损伤
B. 眼外伤
C. 眼炎
D. 急性角膜结膜炎
E. 结膜炎

正确答案：D。急性角膜结膜炎